龈上牙石覆盖面积在牙面1/3与2/3之间，根据CI-S记分标准为
A. 0
B. 1
C. 2
D. 3
E. 4

正确答案：C。2

解析：本题考查牙周病流行病学及分级预防。龈上牙石覆盖面积在牙面1/3与2/3之间，根据CI-S记分标准为2（C对）。CI-S：0＝龈上、龈下无牙石；1＝龈上牙石覆盖面积占牙面1/3以下；2＝龈上牙石覆盖面积在牙面1/3与2/3之间，或牙颈部有散在龈下牙石；3＝龈上牙石覆盖面积占牙面2/3以上，或牙颈部有连续而厚的龈下牙石。